女，23岁。2个月前无明显诱因出现自言自语，有时独自发笑，有时对空谩骂，感觉被人监视和跟踪，思想和行为会被某种外力控制，情绪低落，觉得被逼得走投无路，曾报警寻求保护，睡眠差，实验室检查未发现异常。患者在药物治疗2个月后，症状缓解，但出现停经和泌乳现象，治疗药物最可能是
A. 利培酮
B. 氯氮平
C. 喹硫平
D. 奥氮平
E. 阿立哌唑

正确答案：A。利培酮

解析：利培酮（A对）可通过下丘脑结节漏斗通路引起泌乳素水平升高，而引发闭经、溢乳和性功能障碍。而氯氮平（B错）、喹硫平（C错）、奥氮平（D错）和阿立哌唑（E错）没有或罕见引起催乳素水平升高，不符合题意。